妊娠5个月后用药，可导致日后婴儿牙齿黄染、牙釉质发育不全的药物是
A. 阿莫西林
B. 呋喃妥因
C. 甲硝唑
D. 四环素
E. 磺胺甲恶唑

正确答案：D。四环素

解析：本题考查四环素的不良反应。妊娠5个月后使用四环素（D对）将导致婴儿牙齿黄染，牙釉质发育不全，骨生长障碍。